正确描述肝的是
A. 全部被胸廓所遮盖
B. 位居右季肋区和腹上区
C. 膈面借镰状韧带分为左、右两叶
D. 依据肝静脉系统在肝内的分布情况提出肝段的概念
E. 膈面前部没有腹膜覆盖

正确答案：C。膈面借镰状韧带分为左、右两叶

解析：肝除大部分被肋掩盖外，有一小部分露出于剑突下，直接与腹前壁相接触(A错)，大部分位于右季肋区和腹上区，小部分位于左季肋区(B错)，肝膈面借镰状韧带分为左、右两叶(C对)，依据Glisson系统在肝内的分布情况提出肝段的概念(D错)，膈面除膈后份与膈附着部分及脏面各沟外，都有腹膜(E错)。